妊娠与糖尿病二者间的相互影响错误的是
A. 妊娠可加重糖尿病病情
B. 糖尿病患者妊娠后易发生感染
C. 易并发妊高征、羊水过多、巨大儿
D. 可促进产后子宫恢复正常
E. 畸胎死胎发生率高

正确答案：D。可促进产后子宫恢复正常

解析：妊娠与糖尿病二者间的相互影响有以下几个方面：1.妊娠可以使隐性糖尿病显性化，导致糖尿病患者的病情加重（A对），使既往无糖尿病的孕妇发生GDM；2.高血糖可以使胚胎发育异常甚至死亡，流产率高达15%～30%；3.糖尿病孕妇因小血管内皮细胞增厚及管腔变窄，组织供血不足，妊娠期高血压疾病的发生率是非糖尿病孕妇的2～4倍，糖尿病合并肾脏病时，其发病率高达50%以上；4.糖尿病孕妇白细胞功能缺陷极易并发感染（B对），如外阴阴道假丝酵母病、肾盂肾炎、无症状菌尿症、产褥感染及乳腺炎等，甚至败血症；5.因胎儿高血糖、高渗性利尿导致胎尿排出增多极易并发羊水过多（C对），发生率较非糖尿病孕妇增高10倍；6.易发生糖尿病酮症酸中毒，因孕期代谢紊乱，脂肪分解加速，血糖高而胰岛素不足，血清酮体急剧升高，进而发展为代谢性酸中毒，孕早期可致胎儿畸形，中晚期易致胎儿窘迫及胎死宫内（E对）；8.GDM孕妇再次妊娠时，复发率高达33%～69%。